以上名言为孙思邈所述的是
A. “作为医生，不可能一方面赚钱，一方而从事伟大的艺术-医学”
B. “医生要有一切必要的知识，要洁身自持，要使患者信赖…s”
C. “启我爱医术，复爱世间人”
D. “愿绝名利心，一切为病人，无分爱与憎，不问富与贫，凡诸疾病者，一视如同仁”
E. “无论贵贱贫富长幼妍媸华夷愚智，普同一等，皆如至亲之想”

正确答案：E。“无论贵贱贫富长幼妍媸华夷愚智，普同一等，皆如至亲之想”

解析：我国唐代伟大医学家孙思邈在《千金要方》中的“大医精诚”篇章中，他主张大医必须“精”和“诚”。所谓“精”就是要求医家不断地学习、提高医疗技术，达到医术精湛；所谓“诚”就是强调医家应具有高尚的医学道德，并明确指出医家要有“大慈侧隐之心”，不得追，求名利，对病人应当普同一等”（E对）、“一心赴救”、认真负责，不得浮夸自吹、低毁他人等。只有具备“精”和“诚”的医家才是“大医”，即高尚优秀的医家。孙思邈本人身体力行，不但医术精湛，而且医德高尚，为历代医家所推崇，也是我国医学道德的开拓者，被称为“药王”。